男，30岁。双侧颞下颌关节外伤性强直致开口受限。全麻时应采取的方法是
A. 麻醉深度达Ⅲ期Ⅱ级后，给予盲探插管
B. 乙醚开放滴入麻醉
C. 经气管切开施全麻
D. 清醒状态下经鼻盲探插管
E. 选用硫喷妥钠静脉麻醉，不插管

正确答案：D。清醒状态下经鼻盲探插管

解析：本题考查全身麻醉。患者双侧颞下颌关节外伤性强直致开口受限，属于盲探经鼻插管的适应证。全麻时应采取的方法是清醒状态下经鼻盲探插管（D对）以免麻醉状态下呼吸道梗阻，危及生命（A错）；或在患者清醒状态下经气管切开插管（C错）。乙醚是一种低毒物质，主要是引起全身麻醉作用，此外，对皮肤及呼吸道黏膜有轻微的刺激作用（B错）。硫喷托钠（E错）多用于全麻诱导，对呼吸中枢有较强的抑制作用，患者意识消失不久后即能出现，用药过快或剂量过大可致呼吸完全停止。